在进行药物疗效分析时，下列哪项是正确的
A. 因为是临床试验，故不需要对照组
B. 试验组、对照组均只选典型病人
C. 试验组、对照组都应选择有代表性者，并且两组是均衡可比的
D. 试验组应选择较轻的病人
E. 对照组应选择较重的病人

正确答案：C。试验组、对照组都应选择有代表性者，并且两组是均衡可比的

解析：本题考查研究对象的选择。在进行实验研究时，应选择对干预措施有效的人群。在临床试验中，选择病例要有统一的、公认的诊断标准，而且最好利用客观的诊断指标，避免把未患病者选入而影响研究的真实效果。要注意研究对象的代表性（C对ABDE错），样本应具备总体的某些基本特征，其比例要能代表总体。